全口或多数乳牙萌出过迟或萌出困难可能与以下哪项有关
A. 佝偻病
B. 甲状腺功能减退
C. 良性脆骨症
D. 全身性骨硬化症
E. 以上均是

正确答案：E。以上均是

解析：个别乳牙萌出过迟较少见，全口或多数乳牙萌出过迟或萌出困难多与全身因素有关。如佝偻病、甲状腺功能减退以及营养缺乏等，佝偻病患儿有可能推迟至出生后14～15个月才开始萌出，并往往伴有釉质、牙本质发育异常。良性脆骨症，即全身性骨硬化症，其唯一表征是乳牙迟萌。掌握“迟萌、多生牙和融合牙”知识点。